男性患儿，6岁半，因右上第一磨牙舌面浅龋前来治疗。医生对其进行了药物治疗，阻止其继续进展。但是患儿两天后口腔不适遂又来复诊，经检查患儿的口腔右上颌颊黏膜有水疱，溃疡，疼痛，若为医源性操作导致的药物性口腔黏膜烧灼，则以下哪种龋病治疗的药物有腐蚀性
A. 75%氟化钠甘油糊剂
B. 2%氟化钠
C. 8%氟化亚锡
D. 10%氨硝酸银
E. 1.23%酸性氟磷酸钠

正确答案：D。10%氨硝酸银

解析：乳牙龋齿药物治疗时的常用药物为2%氟化钠，8%氟化亚锡，1.23%酸性氟磷酸钠溶液，10%氨硝酸银，38%氟化氨银，氟保护漆和75%氟化钠甘油糊剂等溶液。其中除氨硝酸银、氟化氨银外均无腐蚀性，可用于不合作的患儿。掌握“乳牙龋”知识点。